下列矿物药中，属于氧化物类的药材是
A. 雄黄
B. 白矾
C. 石膏
D. 赭石
E. 轻粉

正确答案：D。赭石

解析：本题考查的是矿物类中药的分类。下列矿物药中，属于氧化物类的药材是赭石（D对）。矿物类中药的分类是以矿物中所含的主要成分为依据的。矿物在矿物学上的分类方法有多种，但通常是根据矿物所含主要成分的阴离子或阳离子的种类进行分类。1.按阳离子分类法分类：朱砂、轻粉、红粉等为汞化合物类；磁石、自然铜、赭石等为铁化合物类；石膏、钟乳石、寒水石等为钙化合物类；雄黄（A错）、雌黄、信石等为砷化合物类；白矾、赤石脂等为铝化合物类；胆矾、铜绿等为铜化合物类；密陀僧、铅丹等为铅化合物类；芒硝、硼砂、大青盐等为钠化合物类；滑石为镁化合物类。2.按阴离子分类法分类：朱砂、雄黄、自然铜等为硫化合物类；石膏（C错）、芒硝、白矾（B错）为硫酸盐类；炉甘石、鹅管石为碳酸盐类；磁石、赭石、信石为氧化物类；轻粉（E错）为卤化合物类。